治疗前列腺增生，肾阳不足，气化无权证，应首选
A. 金锁固精丸
B. 济生肾气丸
C. 真武汤
D. 附桂八味丸
E. 调元肾气丸

正确答案：B。济生肾气丸

解析：前列腺增生，肾阳不足，气化无权证表现出小便频数，夜间尤甚，尿线变细，余沥不尽，尿程缩短，或点滴不爽，甚则尿闭不通，当有利尿之品，故宜用济生肾气丸，方中具有牛膝与车前子（B对）。金锁固精丸具有温肾固精之功，可用于前列腺炎之肾阳不足证（A错）。真武汤具有温阳利水之功效，但其所利，偏于阳虚水泛证所致的全身或下肢浮肿之水湿，可用于红蝴蝶疮之脾肾阳虚证（C错）。附桂八味丸具有温阳补肾之功，但少利尿之功，同样可用于红蝴蝶疮之脾肾阳虚证（D错）。调元肾气丸可滋阴降火，益气养血，主肾阴不足证（E错）。